男，35岁。车祸后双侧股骨干骨折。BP90/60mmhHg，中心静脉压8cmH₂O。首选的处理措施是
A. 大量输血
B. 强心药治疗
C. 糖皮质激素治疗
D. 应用肾上腺素
E. 补液治疗

正确答案：E。补液治疗

解析：患者双侧股骨干骨折，中心静脉压正常（中心静脉压正常值：5～10cmH₂O），血压低，提示心功能不全或血容量不足，应行补液治疗（E对）予以鉴别。方法为：等渗盐水250ml于5～10min滴完，如血压升高，中心静脉压不变提示血容量不足；如血压不变、中心静脉压上升3～5cmH₂O，提示心功能不全。休克的抢救一般首先快速输入平衡盐溶液，然后输入胶体液，最后才输血（A错）。只有中心静脉压升高，血压降低，提示心功能不全或血容量过多时，才使用强心药（B错）。糖皮质激素（C错）用于重度感染性休克的治疗。肾上腺素（D错）常用于青霉素过敏性休克的急救。